通过和胆汁酸结合而调血脂的药物是
A. 考来烯胺
B. 辛伐他汀
C. 吉非贝齐
D. 烟酸
E. 普罗布考

正确答案：A。考来烯胺

解析：本题考查考来烯胺的作用机制。考来烯胺（A对）在肠道通过离子交换与胆汁酸结合而发挥降血脂作用。